肝静脉注入
A. 肝脏
B. 右心房
C. 上腔静脉
D. 门静脉
E. 下腔静脉

正确答案：E。下腔静脉

解析：下腔静脉（E对）为肝静脉的注入部位，肝静脉包括肝左静脉、肝中静脉和肝右静脉在腔静脉沟处注入下腔静脉。